宜用升浮性药的病证是
A. 病位在上，病势下陷类病证
B. 病位在里，病势上逆类病证
C. 病位在下，病势上逆类病证
D. 病位在表，病势下陷类病证
E. 病位在上，病势上逆类病证

正确答案：A。病位在上，病势下陷类病证

解析：本题考查的是升降沉浮的临床应用。宜用升浮性药的病证是病位在上，病势下陷类病证（A对）。升降沉浮的临床应用：人体的疾病是复杂多变的，疾病的病位有在上、在下、在表、在里，或兼而有之之别，疾病的发展趋势有外发、内陷、上逆、下陷，或兼而有之之异。具体如下：（1）顺其病位选择用药：一般说，病位在上在表类病证（D错），宜选用或配用具有升浮之性的药。病位在下在里类病证（B错），宜用沉降之性的药（C错）。若见表里同病或上下同病，又当浮沉并用或升降并用，以达双向调节之目的（E错）。或选既升浮又沉降，具有双向调节作用的药。或将升浮类药与沉降类药同时配用。（2）逆其病势选择用药：一般说，病势下陷类病证，宜选用或配用具有升浮之性的药。若见病势上逆之证与病势下陷之证同时互见于一体，亦当浮、沉并用，或升、降并用，以达双向调节之目的。（3）据气机运行特点选择用药：有时也根据人体气机升降出入周而复始之特点，在组方遣药时，常将升浮性药与沉降性药同用。至于以何为主，以何为辅，当据情酌定。此外，在特殊情况下，有时也采用顺其病势选择用药法，以因势利导祛除病邪。